男，76岁，晨起突发头疼，右半身麻木伴感觉缺失1小时，既往高血压病史12年，查体：右侧偏身感觉减退伴轻度自发疼痛，四肢肌力正常，病变最可能累及的部位是
A. 左侧丘脑
B. 右侧丘脑
C. 上丘脑
D. 后丘脑
E. 下丘脑

正确答案：A。左侧丘脑

解析：患者老年男性，既往高血压史12年，晨起突发头疼(怀疑高血压导致脑出血），查体右侧偏身感觉减退伴轻度自发疼痛，四肢肌力正常，是丘脑型感觉障碍的特点，且右侧感觉出现障碍，怀疑受累部位是左侧丘脑(A对B错）｡下丘脑(E错）是调节内脏活动和内分泌活动的皮质下中枢，其某些细胞既是神经元又是内分泌细胞，且对体温､摄食水盐平衡和内分泌活动进行调节，同时也参与情绪活动，当被累及的时候会出现一系列非常复杂的症状的和综合征，比如中枢性尿崩症､体温调节障碍､摄食异常､睡眠觉醒障碍､生殖与性功能障碍和现自主神经功能障碍等｡上丘脑（C错）与嗅觉、视觉有密切联系。后丘脑（D错）包括内侧膝状体和外侧膝状体，内侧膝状体接受来自下丘臂的听觉传导通路的纤维，发出纤维至颞叶的听觉中枢，外侧膝状体接受视束的传入纤维，发出纤维至枕叶的视觉中枢。